可摘局部义齿基牙首选
A. 牙周健康，牙周膜面积大
B. 形态正常
C. 位置正常
D. 基牙健康
E. 活髓

正确答案：A。牙周健康，牙周膜面积大

解析：选择健康牙作基牙。牙周健康，牙周膜面积大的牙齿为首选的基牙。切牙牙周膜面积小，又与美观有关，故一般不选作基牙。掌握“局部义齿的设计”知识点。